生后1～3个月添加的辅食是
A. 果汁、菜汁、鱼肝油
B. 铁剂
C. 蛋黄
D. 肉末、豆腐、芋头
E. 果泥、菜泥、米糊

正确答案：A。果汁、菜汁、鱼肝油

解析：生后2周开始补充鱼肝油（含有维生素A、D），生后1～3月可适当添加果汁、菜汁（A对）。对于早产儿，宜自2个月给予铁剂预防，足月儿一般不添加铁剂（B错），及时添加含铁丰富的辅食即可。蛋黄（C错）在生后7个月添加。肉末、豆腐、芋头（D错）在生后7～9月添加。果泥、菜泥、米糊（E错）在生后4～6个月添加。